某地发生一起疾病暴发，有10人发病，全部送医院治疗，并对其排出物进行了彻底消毒。至此，有人认为疫源地已经消灭，针对疫源地的各种措施可以结束，这种说法
A. 正确，因为达到了疫源地消灭的条件
B. 正确，因为传染源已经隔离
C. 错误，因为外界环境只进行消毒不行，还要进行灭菌
D. 错误，易感接触者尚未度过最长潜伏期，还有可能出现病例，形成新的疫源地
E. 以上均不对

正确答案：D。错误，易感接触者尚未度过最长潜伏期，还有可能出现病例，形成新的疫源地